对全口义齿的固位和支持有利的黏膜情况是
A. 厚、松软
B. 厚、韧
C. 薄
D. 薄、干燥
E. B或D

正确答案：B。厚、韧

解析：本题考查口腔黏膜的性质与义齿固位。全口义齿黏膜厚度适宜，有一定的韧性（B对）有利于全口义齿的固位和支持，如黏膜过薄（C错）没有弹性，则基托组织面不易贴合，边缘封闭差，义齿固位也差，并容易产生压痛。黏膜厚但松软（A错）时，全口义齿的支持力差。黏膜干燥（D错），则减低义齿的固位。